试戴时，可采用如下方法判断颌位关系是否正确，除了
A. 用后牙咬合时，双侧颞部肌肉收缩明显
B. 咬合时，义齿基托是否有移动，扭动
C. 张口时，上颌义齿是否有脱落
D. 卷舌后，下颌是否还能后退
E. 后牙咬合时，是否偏向一侧

正确答案：C。张口时，上颌义齿是否有脱落

解析：本题考查判断颌位关系是否正确的方法。张口时，上颌义齿是否有脱落（C错，为本题的正确答案），可用于检查义齿的固位，而不能检查其颌位关系。用后牙咬合时，双侧颞部肌肉收缩明显（A对），说明下颌没有前伸。咬合时，检查义齿基托是否有移动扭动（B对），可用于检查颌位关系是否正确。卷舌时，下颌位于正中咬合位，此时检查下颌是否还能后退（D对），可用于检查前后方向的颌位关系是否正确。后牙咬合时，义齿是否偏向一侧（E对），可用于检查义齿的水平方向颌位关系是否正确。